患者胃脘疼痛反复发作，隐痛为主，喜温喜按，劳累、受凉后加重，空腹痛甚，进食后缓解，神疲乏力，四肢倦怠，手足不温，大便溏薄，舌淡苔白，脉虚弱。治疗应首选的方剂是
A. 藿香正气丸
B. 黄芪建中汤
C. 芍药甘草汤
D. 附子理中丸
E. 香砂六君子汤

正确答案：B。黄芪建中汤

解析：题中患者胃脘疼痛，诊断为胃痛，隐痛、喜温喜按、受凉后加重、手足不温等提示虚寒证，为脾胃虚寒，失于温养所致，治宜温中健脾，和胃止痛，代表方为黄芪建中汤（B对）。藿香正气丸解表化湿，理气和中，用于暑湿感冒（A错），芍药甘草汤主治津液受损，阴血不足，筋脉失濡所致诸症（C错），附子理中丸温中健脾，用于脘腹冷痛，肢冷便溏（D错），香砂六君子汤益气健脾，行气化痰，主治脾胃气虚，痰阻气滞证（E错）。